具有重浊黏滞致病特点的邪气是
A. 燥邪
B. 火邪
C. 风邪
D. 寒邪
E. 湿邪

正确答案：E。湿邪

解析：湿为重浊之邪，属阴，其性重浊、黏滞，易伤阳气，易阻气机，易袭阴位（E对）。燥性干涩，易伤津、伤肺（A错）。火热为阳邪，易伤津耗气、生风动血，易致阳性疮痈，其性炎上，故火热之邪易侵害人体上部，尤以头面部为多见（B错）。风为百病之长，主动，善行而数变，轻扬开泄、易袭阳位（C错）。寒邪性收引、凝滞，易伤阳气（D错）。